有机药物多数为弱酸或弱碱，在体液中只能部分解离，以解离的形式非解离的形式同时存在于体液中，当pH=pKₐ时，分子型和离子型药物所占比例分别为
A. 90%和10%
B. 10%和90%
C. 50%和50%
D. 33.3%和66.7%
E. 66.7%和33.3%

正确答案：C。50%和50%

解析：本题考查药物的酸碱性对药效的影响。药物在解离50%时溶液的pH值就是pKₐ值，即当pH=pKₐ时，分子型和离子型药物所占比例分别为50%、50%（C对）。对于酸性药物，倘若溶液环境pH＜pKₐ， 解离度＜50%，非解离型药物浓度大于解离型药物浓度，可以理解为酸性药物在pH越小即越酸性的环境，未解离的越多，药物的吸收越多。而对于碱性药物，倘若溶液环境pH＞pKₐ，解离度＞50%，解离型药物浓度大于非解离型药物浓度，可以理解为碱性药物，在pH越小即越酸性的环境中，解离的越多，药物吸收的越少。